脱水与酸中毒纠正后，患儿突然发生惊厥，应首先考虑
A. 低镁血症
B. 低钙血症
C. 低血糖症
D. 低钠血症
E. 碱中毒

正确答案：B。低钙血症

解析：小儿突发惊厥可能是脑炎、高热、脑膜炎、血钙过低、大脑发育不全、癫痫、水中毒、低钠血症、高钠血症、低镁血症及低钙血症等疾病引起，而患儿又有脱水病史，易致体内电解质丢失。酸中毒纠正后，游离钙减少导致低钙血症，而出现惊厥（B对）。